某男，50岁。久咳乏力，痰多清稀，食欲减退，大便溏薄，四肢无力；舌淡苔薄，脉弱。诊断为咳嗽，证属肺脾气虚，应采用的治法是
A. 佐金平木法
B. 金水相生法
C. 培土生金法
D. 益火补土法
E. 培土制水法

正确答案：C。培土生金法

解析：本题考查培土生金法的治则治法。诊断为咳嗽，证属肺脾气虚，应采用的治法是培土生金法（C对）。根据相生规律确定的治法，主要有滋水涵木法、培土生金法、金水相生法、益火补土法等。培土生金法：通过补脾益气而补益肺气的治法，又称补养脾肺法。适用于脾胃气虚，生化减少，而致肺气失养的肺脾气虚证。根据五行相克规律确定的治法，主要有抑木扶土法、培土制水法、佐金平木法、泻南补北法等。金水相生法（B错）：滋补肺肾阴虚的治法，又称补肺滋肾法、滋养肺肾法。适用于肺阴虚不能布津以滋肾，或肾阴亏虚，不能上荣于肺，而致肺肾阴虚的病证。益火补土法（D错）：温肾阳以补脾阳的治法，又称温肾健脾法（火，在此是指命门之火，而非心火。益火，补益命门之火，即温肾阳之法）。适用于肾阳衰微而致脾阳不振的脾肾阳虚证。临床可见畏寒肢冷，腰膝冷痛，腹泻，完谷不化，或五更泄泻，舌淡胖边有齿痕，苔白滑，脉沉无力等症。根据五行相克规律确定的治法，主要有抑木扶土法、培土制水法、佐金平木法、泻南补北法等。佐金平本法（A错）：滋肺阴、清肝火的治法，又称滋肺清肝法。适用于肺阴不足，肝火上逆犯肺之证。若因肝火太盛，耗伤肺阴的肝火犯肺之证，又当以清肝火为主，兼以滋肺降气。培土制水法（E错）：健脾利水以制约水湿停聚的治法，又称敦土利水法。适用于脾虚不运、水湿泛溢而致水肿胀满的证候。